大豆中含有影响人体对某些营养素的消化吸收的抗营养因子
A. 胰蛋白酶抑制剂
B. 豆腥昧
C. 胀气因子
D. 植物血细胞凝集素
E. 以上都是

正确答案：E。以上都是